治疗痛经气滞血瘀证,应首选的方剂是
A. 血府逐瘀汤
B. 膈下逐瘀汤
C. 少腹逐瘀汤
D. 桃红四物汤
E. 温经散寒汤

正确答案：B。膈下逐瘀汤

解析：痛经气滞血瘀证，治以理气行滞，化瘀止痛，用膈下逐瘀汤（B对）。血府逐瘀汤主治胸中血瘀证（A错）。痛经寒凝血瘀证，治法温经散寒，化瘀止痛，用少腹逐瘀汤（C错）。桃红四物汤主治血虚兼血瘀证（D错）。痛经寒凝血瘀证，治法温经散寒，化瘀止痛，用温经散寒汤（E错）。